关于HLA-Ⅱ类抗原分子正确的是
A. 由α链和β2m链组成
B. 呈递外源性抗原
C. 分布在所有有核细胞的表面
D. 由HLA A、B、C等基因编码
E. 可与CD8分子结合

正确答案：B。呈递外源性抗原

解析：HLA-II类抗原分子是HLA-II类基因的表达产物，由α链和β链组成（A错），仅表达于淋巴组织中某些特定的细胞表面（C错），能识别和提呈外源性抗原肽（B对），与辅助受体CD4结合（E错）。HLA A、B、C等基因编码HLA-Ⅰ类抗原分子（D错）。